下面哪项属于学校经常性卫生监督的内容
A. 学校食品卫生
B. 学生文具
C. 学生课桌椅
D. 学校面积和平面布局设计
E. 校址的选择

正确答案：A。学校食品卫生